麻疹合并肺炎，需要隔离的时间至
A. 出疹后3天
B. 出疹后5天
C. 出疹后7天
D. 出疹后10天
E. 出疹后14天

正确答案：D。出疹后10天